顺铂的主要不良反应是
A. 心脏毒性
B. 肾脏毒性
C. 肺脏毒性
D. 骨髓毒性
E. 皮肤毒性

正确答案：B。肾脏毒性

解析：顺铂的主要不良反应是肾毒性（B对），骨髓毒性、消化道症状（恶心、呕吐、厌食等）也较常见。心脏毒性（A错）为阿霉素的不良反应。药物很少导致肺脏毒性（C错）和皮肤毒性（E错）。